可用于治疗高血压急症的药物是
A. 福辛普利
B. 缬沙坦
C. 厄贝沙坦
D. 氯沙坦
E. 卡托普利

正确答案：E。卡托普利

解析：本题考查卡托普利。可用于治疗高血压急症的药物是卡托普利（E对）。福辛普利（A错）属于血管紧张素转换酶抑制剂，适用于治疗高血压和心力衰竭。缬沙坦（B错）属于ARB类药物，适用于伴慢性心力衰竭、心肌梗死后伴心功能不全、糖尿病肾病、非糖尿病肾病、代谢综合征、蛋白尿或微量白蛋白尿患者的降压治疗。厄贝沙坦（C错）属于血管紧张素Ⅱ受体阻断剂，适用于治疗原发性高血压。氯沙坦（D错）为血管紧张素Ⅱ受体拮抗剂（ARB），临床可用于治疗慢性心功能不全、心力衰竭、高血压等。